既来之，则安之是形容
A. 角色行为异常
B. 角色行为冲突
C. 角色行为适应
D. 角色行为强化
E. 角色行为减退

正确答案：C。角色行为适应

解析：角色行为适应：患者基本上已与患者角色的“指定心理活动和行为模式”相符合。表现为比较冷静，客观地面对现实。“既来之，则安之”，关注自身的疾病，遵行医嘱，主动采取必要的措施减轻病痛。患者角色适应的结果有利于疾病的康复。掌握“患者角色和求医行为”知识点。